心源性水肿是哪种疾病表现
A. 感染性心内膜炎
B. 急性肺水肿
C. 高血压心脏病
D. 右心衰竭
E. 左心衰竭

正确答案：D。右心衰竭

解析：心源性水肿史右心衰竭的表现（D对）。感染症状发热是心内膜炎最常见的症状。几乎所有的患者都有过不同程度的发热、热型不规则、热程较长，个别患者无发热。此外患者有疲乏、盗汗、食欲减退、体重减轻、关节痛、皮肤苍白等表现（A错）。急性肺水肿临床主要表现为：突然出现严重的呼吸困难，端坐呼吸，伴咳嗽，常咳出粉红色泡沫样痰，病人烦躁不安，口唇紫绀，大汗淋漓，心率增快，两肺布满湿罗音及哮鸣音，严重者可引起晕厥及心脏骤停（B错）。高血压心脏病表现为左心衰症状，查体可发现心尖搏动增强（C错）。左心衰竭以肺循环淤血为主要特征（E错）。